《临证指南医案》所说具有“体阴而用阳”特点的脏是
A. 肝
B. 心
C. 脾
D. 肺
E. 肾

正确答案：A。肝

解析：肝的主要生理机能是主疏泄和主藏血。肝“体阴而用阳”是中医学对肝脏生理病理的概括。“体”是指肝脏的本体，“用”则为肝脏的功能活动。肝藏血，血为阴，足厥阴肝经，所以肝的实体为阴，肝主疏泄，疏泄体现阳的特性（A对）。心的生理特性是为阳脏而主通明（B错）。脾的主要生理机能是主运化，统摄血液（C错）。肺的主要生理机能是主气司呼吸，主行水，朝百脉，主治节（D错）。肾的主要生理机能是主藏精，主水，主纳气（E错）。